长期大剂量服用维生素D可能引起的不良反应是
A. 血栓性静脉炎
B. 高钙血症
C. 高胆红素血症
D. 颅内压升高
E. 乳腺肿大

正确答案：B。高钙血症

解析：本题考查维生素D的不良反应。维生素D不良反应为高钙血症（B对）。血栓性静脉炎（A错）、乳腺肿大（E错）是服用维生素E的不良反应。高胆红素血症（C错）是服用维生素K₁的不良反应。